现行《中小学校教室采光和照明卫生标准》规定，教室黑板面的照度均匀度不低于
A. 0.5
B. 0.6
C. 0.7
D. 0.8
E. 0.9

正确答案：C。0.7